药物临床评价是指
A. 对药物临床前研究的一切新药申报资料进行评估
B. 新药上市以后对药品的理化性质和质量的评估
C. 新药临床研究在未上市以前进行的临床评估
D. 药物药理毒理研究为临床使用打基础的评估
E. 对上市药品的治疗效果、不良反应等进行评估

正确答案：E。对上市药品的治疗效果、不良反应等进行评估

解析：本题考查药物临床评价。药物临床评价是指根据医药学的最新技术水平，从药理学、药剂学、临床药学、药物流行病学、药物经济学及药品管理政策方面，对药品在治疗效果、不良反应、用药方案、贮存稳定性及药品经济学等方面进行实事求是的评估（E对）。